牙龈出血的原因不包括
A. 炎症
B. 血小板减少性紫癜
C. 急性白血病
D. 再生障碍性贫血
E. 艾迪生病

正确答案：E。艾迪生病

解析：本题考查牙龈出血的原因。牙龈出血的原因不包括艾迪生病（E错，为本题的正确答案）。艾迪生病又称原发性慢性肾上腺皮质功能减退症，是由于各种原因破坏双侧肾上腺的绝大部分，引起肾上腺皮质激素分泌不足所致，色素沉着是本病早期症状之一，也是最具特征性的表现，一般不引起牙龈出血。牙龈出血是指牙龈自发性的或由于轻微刺激引起的少量流血，轻者表现为仅在吮吸、刷牙、咀嚼较硬食物时唾液中带有血丝，重者在牙龈受到轻微刺激时即出血较多甚至自发性出血。一般而言，牙龈的慢性炎症（A对）是牙龈出血的常见原因，故牙龈出血多见于牙周炎和牙龈炎患者，但有时也可以是某些系统性疾病的口腔表现，如血小板减少性紫癜（B对）、急性白血病（C对）、再生障碍性贫血（D对）、血友病等。